患者男性，64岁，头晕、心悸4～5年，心尖搏动向左下移位，呈抬举性搏动，于胸骨左缘第3、4肋间闻及叹气样舒张期杂音，为递减型，向心尖传导，在心尖区闻及隆隆样舒张早期杂音，股动脉可闻及射枪音，首先应想到的诊断为
A. 二尖瓣狭窄
B. 主动脉瓣关闭不全
C. 二尖瓣关闭不全
D. 主动脉瓣狭窄
E. 室间隔缺损

正确答案：B。主动脉瓣关闭不全

解析：患者老年男性，有头晕心悸症状，心尖搏动向左下移位（提示左心室增大），呈抬举性搏动；于胸骨左缘第3、4肋间闻及叹气样舒张期杂音（主动脉瓣关闭不全的典型杂音），为递减型，向心尖传导；心尖区也可闻及隆隆样舒张早期杂音（Austin-Flint杂音，常由主动脉瓣关闭不全导致的反流引起）；股动脉可闻及射枪音（主动脉瓣关闭不全时常见的周围血管征），结合患者的病史、典型体征，首先应想到的诊断为主动脉瓣关闭不全（B对）。二尖瓣狭窄（P287）（A错）特征性的杂音为心尖区舒张中晚期低调的隆隆样杂音，合并严重肺动脉高压时，还可在胸骨左缘第2肋间闻及叹气样舒张早期杂音（Graham-Steel杂音）；二尖瓣关闭不全（P292）（C错）的典型杂音为心尖区全收缩期吹风样杂音，可伴有收缩期震颤；主动脉瓣狭窄（P296）（D错）可于胸骨右缘1～2肋间闻及粗糙而响亮的射流性杂音，3/6级以上，呈递增-递减型，向颈部传导；室间隔缺损（P273）（E错）沿胸骨左缘第3～4肋间可闻及Ⅳ-Ⅵ级全收缩期杂音伴震颤。